引起粉尘沉着症的粉尘是
A. 铅、砷、锰粉尘
B. 锡、铁、钡粉尘
C. 煤、石墨、碳黑、活性炭
D. 石棉、矽尘、煤尘
E. 面粉、茶尘、花粉

正确答案：B。锡、铁、钡粉尘